地塞米松的临床应用不包括
A. 风湿性心肌炎
B. 感染中毒性休克
C. 过敏性紫癜
D. 骨质疏松
E. 系统性红斑狼疮

正确答案：D。骨质疏松

解析：地塞米松的临床应用：1.严重感染或炎症；2.免疫相关疾病；3.抗休克治疗；4.血液病；5.局部应用；6.替代治疗等。其中免疫相关疾病中包括自身免疫疾病如严重风湿热、风湿性心肌炎（A对）、风湿性及类风湿性关节炎、全身性红斑狼疮（E对）、自身免疫性贫血和肾病综合征等。抗休克治疗中包括感染中毒性休克（B对）、过敏性休克和低血容量性休克。血液病中包括再生障碍性贫血、粒细胞减少症、血小板减少症和过敏性紫癜（C对）等。而长期大剂量应用引起的不良反应包括：1.医源性肾上腺皮质功能亢进；2.诱发或加重感染；3.消化系统并发症；4.心血管系统并发症；5.骨质疏松（D错，为本题正确答案）、肌肉萎缩、伤口愈合迟缓等；6.糖尿病；7.其他。